我国西南某城市数年前发生一次天然气井喷事故，事故周围居民死伤数十人，并严重影响周围居民居住，不少居民搬迁。该事件属于
A. 突然发生并严重损害公众健康
B. 意料之中，应对方案没有处理好
C. 属于可控事件
D. 属于人为事故
E. 属于不可预料事故

正确答案：A。突然发生并严重损害公众健康

解析：各种事故可分为两大类，即责任事故和非责任事故，责任事故是指由事故单位或从业人员的不安全行为所引发的事故，即人为原因造成的事故：非责任事故是指由于自然界的因素而造成不可抗拒的事故，或由于当前科学技术条件的限制而发生的难以预料的事故。事故性质属于责任事故还是非责任事故应该确定于调查之后。题干没有提及开展调查，因此不能确定此事件为意料之中，应对没有方案处理好（B错）或此事件属于可控事件（C错）、人为事故（D错）、不可预料事故（E错）。题干有提及事故周围居民死伤数十人，并严重影响周围居民居住，因此该事件属于突然发生并严重损害公众健康（A对）。